女，26岁。妊娠8周，阵发性下腹痛2天，阴道少量流血5小时。为决定是否继续妊娠，最有价值的辅助检查是
A. 检测血清甲胎蛋白值
B. 尿妊娠试验
C. 检测血清雌三醇值
D. B超检查
E. 检测血清雌二醇值

正确答案：D。B超检查

解析：26岁女性，妊娠8周，阵发性下腹痛2天，阴道少量流血5小时（先兆流产表现为阴道少量流血和阵发性腹痛），应诊断为先兆流产。对疑为先兆流产者，应根据B型超声检查（D对）观察妊娠囊的形态，有无胎心搏动，确定胚胎或胎儿是否存活，决定是否继续妊娠。尿妊娠试验（P49）（B错）临床多用于早早孕诊断。检测血清雌三醇值（C错）、血清雌二醇值（E错）能协助判断先兆流产的预后，但不如B超直接有效。测血清甲胎蛋白值（P414）（A错）主要用于诊断卵巢内胚窦瘤、卵巢胚胎性癌、肝癌等，与先兆流产的预后无关。